电复律的绝对适应证是
A. 阵发性室性心动过速
B. 心室颤动
C. 心房颤动
D. 预激综合征伴快速心房颤动
E. 心房扑动

正确答案：B。心室颤动

解析：电复律治疗适用于各种类型的快速性心律失常，包括：第一，心室颤动和心室扑动应首选心脏电复律治疗（B对）。经各种药物治疗无效的各类快速性心律失常，包括室性心动过速、室上性心动过速、伴有快速心室率的心房颤动和心房扑动等等（AC错）。伴有明显血流动力学障碍的心房颤动、心房扑动、室性心动过速和室上性心动过速等等；或性质不明或伴有预激综合征的各种异位快速性心律失常，都适用于心脏电复律治疗，但不是绝对适应证（DE错）。